患者水肿日久，腰以下肿甚，按之凹陷不起，畏寒肢冷，尿少，舌淡苔白滑，脉沉弱。其证候是
A. 风水泛滥
B. 湿毒浸淫
C. 水湿浸渍
D. 湿热壅盛
E. 脾阳虚衰

正确答案：E。脾阳虚衰

解析：中阳不运，健运失司，气不化水，以致下焦水邪泛滥，故身肿日久，腰以下为甚，按之凹陷不易恢复；阳气虚衰，则畏寒肢冷；阳不化气，故尿少；舌淡苔白滑，脉沉弱，为脾阳虚衰，水湿内聚之征，故诊断为水肿脾阳虚衰证（E对）。水肿之风水泛滥证，其证候为眼睑浮肿，继则四肢及全身皆肿，来势迅速，多有恶寒，发热，肢节酸痛，小便不利等症。偏于风热者，伴咽喉红肿疼痛，口渴，舌质红，脉浮滑数。偏于风寒者，兼恶寒，咳喘，舌苔薄白，脉浮滑或浮紧（A错）。水肿之湿毒浸淫证，其临床表现为眼睑浮肿，延及全身，皮肤光亮，尿少色赤，身发疮痍，甚则溃烂，恶风发热，舌质红，苔薄黄，脉浮数或滑数(B错)。水肿之水湿浸渍证，其临床表现为全身水肿，下肢明显，按之没指，小便短少，身体困重，胸闷腹胀，纳呆，泛恶，苔白腻，脉沉缓，起病较缓，病程较长（C错）。水肿之湿热壅盛证，其临床表现为遍体浮肿，皮肤绷急光亮，胸脘痞闷，烦热口渴，或口苦口粘，小便短赤，或大便干结，舌红，苔黄腻，脉滑数或沉数（D错）。